矽肺患者最常见的并发症是
A. 肺源性心脏病
B. 肺结核
C. 自发性气胸
D. 结核性胸膜炎
E. 支气管哮喘

正确答案：B。肺结核

解析：本题考查矽肺的并发症。矽肺常见并发症有肺结核、肺及支气管感染、自发性气胸、肺心病等。一旦出现并发症，病情进展加剧，甚至死亡。其中，最为常见和危害最大的是肺结核（B对ACDE错）。矽肺如果合并肺结核，矽肺的病情恶化，结核难以控制，矽肺合并肺结核是病人死亡的最常见原因。